男，35岁。活动后气短2年，加重伴双下肢水肿2个月。查体：颈静脉怒张，双肺底可闻及少量湿性啰音。心界扩大，心率100次/分，律齐，可闻及S3，心尖部可闻及2/6级收缩期吹风样杂音。肝肋下4cm。超声心动图示全心扩大，室壁运动呈弥漫性减弱。实验室检查：尿蛋白（+）。该患者最可能的诊断是
A. 缩窄性心包炎
B. 肝硬化
C. 心包积液
D. 慢性肾炎
E. 扩张型心肌病

正确答案：E。扩张型心肌病

解析：患者青年男性（扩张性心肌病多发人群），活动后气短2年，加重伴双下肢水肿2个月（心衰常见症状）。查体：颈静脉怒张，双肺底可闻及少量湿性啰音。心界扩大，心率100次/分，律齐，可闻及S3，心尖部可闻及2/6级收缩期吹风样杂音（扩张性心肌病常见体征）。肝肋下4cm。超声心动图示全心扩大，室壁运动呈弥漫性减弱（扩张性心肌病典型影像学表现）。结合患者临床表现及相关辅助检查结果初步诊断为扩张型心肌病（E对）。缩窄性心包炎（A错）典型的超声表现为心包增厚，室壁活动减弱，室间的隔异常活动，即室间隔抖动征，下腔静脉增宽且不随呼吸变化。肝硬化（B错）患者多存在多年的基础肝病如肝炎等，主要表现以肝功能异常为主。心包积液（C错）临床特征主要表现为：低血压、心音低弱、颈静脉怒张、Ewart征。慢性肾炎（D错）以蛋白尿、血尿、高血压、水肿为基本临床表现，并伴有有不同程度的肾功能减退。